脑猪囊尾蚴病的临床表现复杂多样，但最常见的临床类型是
A. 脑实质型
B. 脑室型
C. 软脑膜型
D. 脊髓型
E. 混合型

正确答案：A。脑实质型

解析：第八版传染病学将脑猪囊尾蚴病分为4型：皮质型（最常见），脑室型，蛛网膜下隙型或颅底型，混合型（E错）。老版将猪囊尾蚴病分为4型：脑实质型（占80%）（A对），脑室型（占10%）（B错），软脑膜型（占10%）（C错），和脊髓型（及少见）（D错）。